下列各项，可在使用有效抗结核药物的同时，加用糖皮质激素的是
A. 伴咯血
B. 空洞形成
C. 急性粟粒型肺结核
D. 干性胸膜炎
E. 抗痨药引起肝损伤

正确答案：C。急性粟粒型肺结核

解析：糖皮质激素治疗结核病适用于结核毒性症状严重者，急性粟粒型肺结核（C对）为肺结核最严重的类型，结核毒性症状极其严重，故可在使用有效抗结核药物的同时，加用糖皮质激素。几乎所有肺结核患者均有痰中带血或咯血，故咯血（A错）不是结核毒性症状严重的表现，故无需加用糖皮质激素。空洞形成（B错）为空洞性肺结核的表现，属于活动性肺结核，具有传染性，但不表明结核毒性症状严重。干性胸膜炎（C错）是结核性胸膜炎早期表现，表现为起病急、发热，并有轻度胸痛、咳嗽或呼吸时疼痛加剧，结核毒性症状并不严重。抗痨药（E错）引起的肝损害，若仅为无症状的轻度转氨酶升高，则无需处理，绝大多数患者转氨酶可恢复正常；若出现食欲不振、黄疸或肝大应立即停药，直至肝功能恢复正常。